下列药品中可以申请委托生产的是
A. 复方板蓝根颗粒
B. 曲马多片
C. 清开灵注射液
D. 盐酸麻黄碱滴鼻液

正确答案：A。复方板蓝根颗粒

解析：本题考查的是依法自行生产或委托生产药品。下列药品中可以申请委托生产的是复方板蓝根颗粒（A对）。依法自行生产或委托生产药品：上市许可持有人自行生产药品的，应当依照《药品管理法》规定取得药品生产许可证；委托生产的，应当委托符合条件的药品生产企业。药品上市许可持有人和受托生产企业应当签订委托协议和质量协议，并严格履行协议约定的义务。血液制品、麻醉药品、精神药品、医疗用毒性药品、药品类易制毒化学品不得委托生产；但是，国务院药品监督管理部门另有规定的除外。曲马多片（B错）属于第二类精神药品、盐酸麻黄碱滴鼻剂属于药品类易制毒化学品，均不得委托生产。清开灵注射液（C错）属于中药注射剂。